下面哪一项不是开放式问题的缺点
A. 限于知识水平和语言表达能力，适用范围有限
B. 问题和答案太长，容易使人厌倦
C. 回答开放式问题需要费较多时间和精力
D. 许多人不习惯或不乐意用文字表达看法
E. 统计处理难以归类

正确答案：B。问题和答案太长，容易使人厌倦